只有一种核酸类型的微生物是
A. 衣原体
B. 病毒
C. 支原体
D. 螺旋体
E. 真菌

正确答案：B。病毒

解析：病毒（B对）无细胞结构，只有一种核酸类型，可分为DNA病毒和RNA病毒。衣原体（A错）、支原体（C错）、螺旋体（D错）、真菌（E错）都有细胞结构，都有DNA和RNA两种核酸类型。